属于二级保护野生药材的是
A. 黄连
B. 黄芩
C. 秦艽
D. 细辛
E. 连翘

正确答案：A。黄连

解析：本题考查二级保护野生药材。属于二级保护野生药材的是黄连（A对）。二级保护野生药材物种系指分布区域缩小，资源处于衰竭状态的重要野生药材物种。二级保护药材名称：鹿茸（马鹿）、麝香（3个品种）、熊胆（2个品种）、穿山甲、蟾酥（2个品种）、哈蟆油、金钱白花蛇、乌梢蛇、蛤蚧、甘草（3个品种）、黄连（3个品种）、人参、杜仲、厚朴（2个品种）、黄柏（2个品种）、血竭。黄芩（B错）、秦艽（C错）、细辛（D错）、连翘（E错）属于三级保护野生药材物种。